最多发生双侧颈淋巴结转移的肿瘤是
A. 舌癌
B. 口底癌
C. 颊癌
D. 腭癌
E. 上颌窦癌

正确答案：B。口底癌

解析：口底癌早期常发生于舌系带的一侧或中线两侧，多为中度分化的鳞状细胞癌。生长于口底前部者，其恶性程度较后部为低。口底癌常早期发生淋巴结转移，转移率仅次于舌癌，一般转移至颏下、下颌下及颈深淋巴结，但大都先有下颌下区转移，以后转移到颈深淋巴结，并常发生双侧颈淋巴结转移。掌握“颊癌、口底癌及唇癌”知识点。